治疗肾病综合征阴虚湿热证，应首选
A. 真武汤合五苓散
B. 大补阴丸合猪苓汤
C. 参芪麦味地黄汤
D. 桂枝茯苓丸合五苓散
E. 知柏地黄丸

正确答案：B。大补阴丸合猪苓汤

解析：肾病综合征阴虚湿热证治宜滋阴泄热，利水祛湿，选用大补阴丸滋阴泻火合猪苓汤利水养阴清热（B对）。真武汤合五苓散温阳健脾，化气行水适用于肾病综合征脾肾阳虚证（A错）。参芪麦味地黄汤益气养阴适用于慢性肾小球肾炎气阴两虚型（C错）。桂枝茯苓丸活血，化瘀合五苓散温阳化气，利湿行水适用于阳虚水湿内停瘀血阻滞之证（D错）。知柏地黄丸功用滋阴降火适用于隐匿性肾小球肾炎阴虚火旺证（E错）。